以下疾病中，在病理学中可以称为“错构瘤”或“发育畸形”的为
A. 牙源性钙化上皮瘤
B. 成釉细胞瘤
C. 牙瘤
D. 牙源性角化囊性瘤
E. 成釉细胞纤维瘤

正确答案：C。牙瘤

解析：牙瘤是成牙组织的错构瘤，或发育畸形，不是真性肿瘤。掌握“牙瘤”知识点。